选择性抑制COX-2的非甾体抗炎药，胃肠道副作用小，但在临床使用中具有潜在心血管事件风险的药物是
A. 阿司匹林
B. 对乙酰氨基酚
C. 贝诺酯
D. 塞来昔布
E. 布洛芬

正确答案：D。塞来昔布

解析：本题考查药物的作用。塞来昔布（D对）是选择性抑制COX-2的非甾体抗炎药，COX-2可影响电解质代谢和血压，而COX-1具有心血管保护作用。COX-2抑制剂在阻断前列环素产生的同时，并不能抑制血栓素的生成，有可能打破体内促凝血和抗凝血系统的平衡，理论上会增加心血管事件的发生率。阿司匹林（A错）为环氧合酶（COX）的不可逆抑制剂，可以使COX发生乙酰化反应而失去活性。对乙酰氨基酚（B错）通过抑制下丘脑体温调节中枢前列腺素合成酶，减少前列腺素PGE₁、缓激肽和组胺等的合成和释放。贝诺酯（C错）为对乙酰氨基酚与阿司匹林形成的酯的前药，在体内水解成原药，具有解热、镇痛及抗炎作用。布洛芬（E错）（S）-异构体的活性比（R）-异构体强28倍，但布洛芬通常以外消旋体上市，因为布洛芬在体内会发生手性异构体间转化，无效的（R）-异构体可转化为有效的（S）-异构体。